男性，37岁。急刹车致使方向盘挤压上腹部16小时，上腹部、腰部及左肩疼痛，持续性，伴恶心、呕吐。查体：体温38.4℃，上腹部肌紧张明显，有压痛，反跳痛不明显，无移动性浊音，肠鸣音存在，胰腺淀粉酶极高。其最可能损伤的脏器是
A. 脾
B. 肝
C. 肾
D. 胰
E. 膀胱

正确答案：D。胰

解析：上腹部汽车方向盘伤，自行车把手伤为胰腺损伤的典型受伤机制，根据题干具有压痛、反跳痛、肩部腰部的持续性放射痛、淀粉酶升高的表现都是胰腺炎的特点，故最可能损伤的脏器是胰（D对）。